女，35岁。因尿频、尿急、尿痛2天就诊。体检：体温38.5℃，右肾区叩痛明显，尿常规蛋白（++），白细胞满视野，红细胞10～15个/HP。此时应予以的处理是
A. 先做中段尿培养，立即给抗革兰氏阴性杆菌药物
B. 立即做中段尿培养，等报告后处理
C. 立即给抗革兰氏阴性杆菌药物
D. 先给抗革兰氏阳性球菌药物
E. 先做B超和肾功能检查

正确答案：A。先做中段尿培养，立即给抗革兰氏阴性杆菌药物

解析：青年女性，出现尿频、尿急、尿痛症状（典型膀胱刺激症状），伴有发热、右肾区叩击痛（提示肾区有感染），尿常规蛋白（++）（正常尿蛋白阴性），白细胞满视野（存在白细胞尿，正常0～5个/HP），红细胞10～15个/HP（存在镜下血尿，正常0～3个/HP），综合该患者的病史、体查、实验室检查，该患者诊断考虑为尿路感染。尿液细菌学检查是诊断尿路感染的可靠证据，通常采用清洁中段尿做细菌培养，但需要一定时间，在病原学结果出来之前，应立即给抗革兰氏阴性杆菌药物（A对），以阻止病情发展。在细菌培养之前，先给抗感染药物（CD错）可使结果出现假阴性（P494）。革兰阴性杆菌是尿路感染最常见的致病菌（其中大肠埃细菌最为常见）（P491），仅少数由革兰氏阳性球菌引起，故应选择抗革兰氏阴性杆菌药物（D错）。B超和肾功能检查（E错）分别有助于了解尿路情况（如有无结石、梗阻、反流、畸形等）和肾脏功能受累程度，必要时可进行检查，但患者目前的首要任务是及时治疗。